艾叶的功效有
A. 温经
B. 止血
C. 散寒
D. 止痛
E. 养肝血

正确答案：A、B、C、D。温经；止血；散寒；止痛